关于斜方肌的作用，错误的是
A. 使肩胛骨向脊柱靠拢
B. 上部肌束可上提肩胛骨
C. 下部肌束使肩胛骨下降
D. 一侧收缩使颈向同侧屈，脸转向同侧
E. 两侧同时收缩可使头后仰

正确答案：D。一侧收缩使颈向同侧屈，脸转向同侧

解析：斜方肌可使肩胛骨向脊柱靠拢（A对），上部肌束可上提肩胛骨（B对），下部肌束使肩胛骨下降（C对），一侧收缩使颈向同侧屈，脸转向对侧，而非同侧（D错，为本题正确答案），两侧同时收缩可使头后仰（E对）。